男，38岁。右膝关节、右踝关节持续性肿痛2个月。既往腰痛14年，伴晨僵，活动后改善。查体：右膝及右踝关节肿胀，有压痛，右膝关节积液，枕墙距2cm，双侧“4”字试验（+）。实验室检查血常规WBC13.2×10⁹/L，Plt383×10⁹/L；ESR78mm/h；RF（-）；HLA－B27（+）。首选的治疗药物是
A. 羟基氯喹
B. 青霉胺
C. 硫酸氨基葡萄糖
D. 秋水仙碱
E. 柳氮磺吡啶

正确答案：E。柳氮磺吡啶

解析：患者青年男性（强直性脊柱炎好发人群），既往腰痛14年，伴晨僵且活动后改善（强直性脊柱炎的典型临床表现）。查体：右膝及右踝关节肿胀，有压痛，右膝关节积液（提示病情进入晚期，向下延伸引起炎症性外周关节炎），枕墙距是为了判断是否存在颈部僵直及是否有胸椎后凸畸形。枕墙距2cm（主要评定颈椎、胸椎后凸程度。其方法是让患者靠墙站立，足跟必须紧贴墙面，测量后枕部与墙之水平距离，正常人枕墙距应为0），双侧“4”字试验（+）（强直性脊柱炎患者常见的体征）。实验室检查：血常规WBC132×10⁹/L（正常值4～10×10⁹/L，偏高）；ESR78mm/h（正常成年男人为0～15mm/h，偏高），两者都偏高提示存在炎症；HLA-B27（+）（90%左右的强直性脊柱炎患者HLA-B27阳性），综合患者的病史、临床表现、查体和实验室检查，考虑诊断为强直性脊柱炎并发外周关节炎。此时的首选的治疗药物是柳氮磺吡啶（E对）。羟基氯喹（P820）（A错）常用于治疗类风湿关节炎、系统性红斑狼疮。青霉胺（B错）属于改善病情抗风湿药，可用于本患者的治疗，但不是首选治疗药物。硫酸氨基葡萄糖（P859）（C错）常用于治疗骨关节炎。秋水仙碱（P863）（D错）常用于治疗痛风性关节炎。